小儿咽鼓管的特点是
A. 较粗短平直
B. 较细长
C. 较细短
D. 较粗长
E. 腔较小

正确答案：A。较粗短平直

解析：幼儿咽鼓管较成人短而平， 管径也较大（A对）。